《中国药典》中，以士的宁为质量控制成分之一的中药
A. 苦参
B. 麻黄
C. 马钱子
D. 连翘
E. 地骨皮

正确答案：C。马钱子

解析：本题考查的是含生物碱类化合物的常用中药。《中国药典》中，以士的宁为质量控制成分之一的中药马钱子（C对）。马钱子成熟种子中生物碱含量为1.5%～5%，主要生物碱是士的宁（又称番木鳖碱）、马钱子碱及其氮氧化物，还含少量的10余种其他吲哚类生物碱，其中以士的宁含量居首，占总碱量的35%～50%，其次是马钱子碱，占总碱量的30%～40%。《中国药典》以士的宁和马钱子碱为指标成分进行含量测定，要求士的宁的含量应为1.20%～2.20%，马钱子碱的含量不得少于0.80%。苦参（A错）所含主要生物碱是苦参碱和氧化苦参碱，《中国药典》以其为指标成分进行鉴别和含量测定，含量测定要求苦参碱和氧化苦参碱总量不得少于1.2%。此外还含有羟基苦参碱、N-甲基金雀花碱、安那吉碱、巴普叶碱和去氢苦参碱（苦参烯碱）等。这些生物碱都属于双稠哌啶类。苦参总生物碱具有抗肿瘤、抗病原微生物、抗心律失常、解热、抗炎、抗变态反应和调节免疫等作用。麻黄（B错）中含有多种生物碱，以麻黄碱和伪麻黄碱为主，前者占总生物碱的40%～90%，《中国药典》以盐酸麻黄碱和盐酸伪麻黄碱为指标成分进行含量测定，要求药材和饮片含盐酸麻黄碱和盐酸伪麻黄碱的总量不得少于0.80%。此外麻黄还含少量的甲基麻黄碱、甲基伪麻黄碱和去甲基麻黄碱、去甲基伪麻黄碱。连翘（D错）中的木脂素类成分多为双环氧木脂素及木脂内酯，《中国药典》以挥发油、连翘苷和连翘酯苷A为指标成分进行含量测定，要求青翘的挥发油含量不得少于2.0%（ml/g），青翘的连翘酯苷A含量不得少于3.5%，老翘含连翘酯苷A不得少于0.25%；对连翘苷含量要求不得少于0.15%。地骨皮（E错）的质量控制成分，2022年考试指南未明确说明。